下列药材伪品中，表面灰褐色，密生环节，断面纤维性，常中空的是
A. 龙胆伪品鬼臼根基根茎
B. 人参伪品华山参根
C. 天麻伪品大丽菊块根
D. 柴胡伪品大叶柴胡根茎
E. 山药伪品木薯块根

正确答案：D。柴胡伪品大叶柴胡根茎

解析：本题考查的是柴胡的伪品。下列药材伪品中，表面灰褐色，密生环节，断面纤维性，常中空的是柴胡伪品大叶柴胡根茎（D对）。大叶柴胡根茎弯曲，长3-9厘米，直径3-8毫米，质坚，黄棕色，密生的环节上多须根。茎单生或2-3，有粗槽纹，多分枝。龙胆伪品鬼臼（A错），根茎横卧，棕褐色，木质化，具粗壮的须状根。人参伪品华山参（B错），表面棕褐色，有黄白色横长皮孔样突起、须根痕及纵皱纹，上部有环纹。质硬，断面类白色或黄白色，皮部狭窄，木部宽广，可见细密的放射状纹理。天麻伪品大丽菊（C错）块根扁缩，纺缍形，象牙白色，有细小的平行纹理，体轻，味淡微甜，嚼之粘牙。山药伪品木薯块根（E错）呈圆柱形，常切成斜片。中央部位有木心（导管群），有的有裂隙，由木心向四周扩散有黄色小点散在，有的呈放射状及环状散在的导管，味谈，嚼之有纤维感。